《热论》“其满三日者，可泄而已”的“泄”法是指
A. 漏泄
B. 蒸发
C. 攻下
D. 泄热
E. 泄汗

正确答案：D。泄热

解析：外感热病，未满三日者，其邪尚在表，可用发汗的方法，祛除邪气（E错），使病痊愈。已满三日者，其邪气已传入里，故可用泄热法（D对）。